女，54岁。有胆囊结石病史8年。上腹剧痛2天，向腰部放射，伴恶心、呕吐，血淀粉酶升高2倍，以下最有价值的检查是
A. 腹部平片
B. 上消化道钡餐
C. 心电图
D. 腹部CT
E. 胃镜

正确答案：D。腹部CT

解析：中年女性患者，有胆囊结石病史8年（胆囊结石是急性胰腺炎的主要病因）。上腹剧痛2天、向腰部放射（急性胰腺炎的典型症状），伴恶心、呕吐（急性胰腺炎的伴发症状），血淀粉酶升高2倍（一般淀粉酶超过正常值3倍才可诊断急性胰腺炎）。综合患者的病史、临床表现，可初步诊断为急性胰腺炎。为确诊，最有价值的检查是腹部CT（D对）。腹部CT（九版外科学P459）不仅能诊断急性胰腺炎，而且能鉴别是否合并胰腺组织坏死。腹部平片（八版外科学P340）（A错）多用于检查消化道穿孔、肠梗阻等疾病。上消化道钡餐（九版外科学P348）（B错）、胃镜（九版外科学P348）（E错）主要用于消化性溃疡、胃癌的诊断。心电图（P180）（C错）主要用于心律失常的诊断。